地高辛的t½=33h，按每日给予治疗量，问血药浓度何时达到稳态
A. 3天
B. 6天
C. 9天
D. 12天
E. 15天

正确答案：B。6天